窝沟封闭是WHO推荐的一种重要的防龋措施，下面关于窝沟封闭的说法，错误的是
A. 窝沟封闭使用的合成高分子树脂材料具有强大的防酸蚀能力
B. 通过隔绝口腔致菌因素的侵害而发挥作用
C. 重点应选择牙面深，窝沟窄的牙齿以及已患早期龋或可疑龋的点隙裂沟进行封闭
D. 乳牙封闭应在3～4岁进行
E. 一生只需进行1次窝沟封闭就够了

正确答案：E。一生只需进行1次窝沟封闭就够了